患者清晨腹痛，痛即作泻，形寒肢冷，神疲，面色白，脉迟无力。其证候是
A. 脾气虚
B. 脾阳虚
C. 寒湿困脾
D. 食滞胃脘
E. 命门火衰

正确答案：E。命门火衰

解析：脾气虚无腹痛，形寒肢冷（A错）。脾阳虚大便多稀溏，无泄泻，尤其是五更泄泻（B错）。寒湿困脾有泛恶欲吐，头身困重等湿象（C错）。食滞胃脘大便酸馊腐臭，腹痛拒按，吐后痛减等症状（D错）。肾阳虚衰，阴寒内盛，气血运行不畅，故腹痛，肾阳不足，火不暖土，脾失健运，故清晨腹痛，痛即作泻，即五更泄泻，肾阳失于温煦，故形寒肢冷；神疲，面色白，脉迟无力均为阳虚之象，故其证候为命门火衰证（E对）。